错误的是
A. 其中无脉络丛
B. 位于延髓、脑桥和小脑之间
C. 其底为菱形窝
D. 向上通中脑水管
E. 有二个外侧孔,一个正中孔

正确答案：A。其中无脉络丛

解析：第四脑室位于延髓、脑桥和小脑之间（B对），其底为菱形窝（C对），两侧角为外侧隐窝，顶向后上朝向小脑蚓。第四脑室后下部由下髓帆及第四脑室脉络组织形成。脉络组织内的部分血管反复分支，相互缠绕成丛状，夹带着室管膜上皮和软膜突入室腔，成为第四脑室脉络丛（A错，为本题正确答案），产生脑脊液。脑脊液在第四脑室内向上经中脑水管（D对）通第三脑室，向下可达延髓下部和脊髓的中央管，并借脉络组织上的3个孔（两个外侧孔，一个正中孔（E对））与蛛网膜下隙相通。